关于热原的错误表述是
A. 热原是微生物的代谢产物
B. 致热能力最强的是革兰阳性杆菌所产生的热原
C. 真菌也能产生热原
D. 活性炭对热原有较强的吸附作用
E. 热原是微生物产生的一种内毒素

正确答案：B。致热能力最强的是革兰阳性杆菌所产生的热原

解析：本题考查热原。热原是微生物产生的一种内毒素，它是能引起恒温动物体温异常升高的致热物质。大多数细菌都能产生热原，其中致热能力最强的是革兰阴性杆菌（B错，为本题正确答案）。热原是微生物的一种内毒素（AE对），存在于细菌的细胞膜和固体膜之间，是磷脂、脂多糖和蛋白质的复合物。其中脂多糖是内毒素的主要成分和致热中心。真菌（C对）（如霉菌）甚至病毒也能产生热原。热原具有过滤性，可被活性炭吸附（D对）。